某男，6岁，患慢性肠炎，症见大便溏泄、饮食减少腹胀、倦怠懒言，宜选用的成药是
A. 香砂平胃颗粒
B. 止泻灵颗粒
C. 小儿消食片
D. 小儿泻速停颗粒
E. 肥儿丸

正确答案：B。止泻灵颗粒

解析：本题考查的是止泻灵颗粒的主治。某男，6岁，患慢性肠炎，症见大便溏泄、饮食减少腹胀、倦怠懒言，宜选用的成药是止泻灵颗粒（B对）。止泻灵颗粒：【主治】脾胃虚弱所致的泄泻、大便溏泄、饮食减少、腹胀、倦怠懒言；慢性肠炎见上述证候者。香砂平胃颗粒（A错）：【主治】湿浊中阻、脾胃不和所致的胃脘疼痛、胸膈满闷、恶心呕吐、纳呆食少。小儿消食片（C错）：【主治】食滞肠胃所致的积滞，症见食少、便秘、脘腹胀满、面黄肌瘦。小儿泻速停颗粒（D错）：【主治】小儿湿热蕴结大肠所致的泄泻，症见大便稀薄如水样、腹痛、纳差；小儿秋季腹泻及迁延性、慢性腹泻见上述证候者。肥儿丸（E错）：【主治】小儿消化不良，虫积腹痛，面黄肌瘦，食少腹胀泄泻。